某有机磷中毒患者，给予大量阿托品治疗。阿托品对有机磷中毒的下列哪种症状无效
A. 大汗
B. 肠痉挛
C. 瞳孔缩小
D. 心率减慢
E. 肌束颤动

正确答案：E。肌束颤动